男性，45岁。发现肝硬化已5年。3天前与朋友聚餐时出现呕血，鲜红色，量约1000ml.患者出现头晕心慌出冷汗等。经输血补液和应用止血药物治疗后病情好转，血压和心率恢复正常。1天前起出现睡眠障碍。并出现幻听和言语不清。化验检查示：血氨130μg/dl，血糖5.6mmol/L，尿素氮7.2mmol/L。患者近一天出现的情况最可能的诊断是
A. 尿毒症
B. 脑血管意外
C. 乙型脑炎
D. 糖尿病酮症酸中毒
E. 肝性脑病

正确答案：E。肝性脑病

解析：中年男性患者，既往有肝硬化病史（肝性脑病形成的基础）5年，3天前上消化道大出血（大于500ml）（肝性脑病形成的诱因）。1天前起出现睡眠障碍，并出现幻听和言语不清（肝性脑病2期的临床表现）。实验室检查：血氨升高（正常值40～80μg/dl），血糖正常（＜6.1mmol/L），尿素氮正常（2.86～7.14mmol/L）。综合该患者病史、临床表现与实验室检查，考虑诊断为肝性脑病（E对）。尿毒症（A错）有肾脏疾病病史，少尿、无尿的临床表现及尿素氮升高等。脑血管意外（B错）多有高血压、血栓形成或外伤等病因，而无血氨升高。乙型脑炎（C错）由乙脑病毒引起，经蚊传播，临床上急起发病，有高热、意识障碍、惊厥、强直性痉挛和脑膜刺激征等。糖尿病酮症酸中毒（P753）（D错）是糖尿病的急性并发症之一，血糖升高，一般为16.7～33.3mmol/L。